用于生长发育期需求增加和慢性失血而引起的贫血，宜选用的药物是
A. 叶酸
B. 维生素B₁₂
C. 亚叶酸钙
D. 维生素K
E. 硫酸亚铁

正确答案：E。硫酸亚铁

解析：常用的铁剂有：硫酸亚铁能预防和治疗缺铁性贫血，尤其对营养不良、妊娠、儿童发育期等需求增加和月经过多、痔疮出血和子宫肌瘤等慢性失血而引起的贫血有确切疗效（E对）。